寒凉药性对人体的不良作用是
A. 伤阴
B. 耗气
C. 伤阳
D. 敛邪
E. 生热

正确答案：C。伤阳